体检时发现，某男子鼻翼两侧有脂溢性皮炎，阴囊两侧出现对称性红斑，覆盖褐色鳞屑；同时眼睛视物模糊、流泪、羞光，口角乳白，唇裂，舌肿大、红斑、疼痛。此人有可能缺乏
A. 维生素PP
B. 维生素B₁
C. 维生素B₂
D. 维生素B₁₂
E. 维生素B₆

正确答案：C。维生素B₂